患者吞咽梗阻，胸膈痞闷，情志舒畅时可稍减轻，口干咽燥，舌偏红苔薄腻，脉弦滑。治疗应首选
A. 通幽汤
B. 涤痰汤
C. 温胆汤
D. 玉枢丹
E. 启膈散

正确答案：E。启膈散

解析：根据患者吞咽梗阻可诊断为噎嗝。吞咽梗阻，胸膈痞闷为气郁痰阻，食道不利；患者症状和情志有关；气结津液不能上承，郁热伤津故口干咽燥；为痰气交阻证；治宜开郁化痰，润燥降气，故选用启膈散（E对）。通幽汤用于治疗瘀血内结证（A错）。涤痰汤功用化痰开窍，治疗癫证（B错）。温胆汤用于治疗呃逆（C错）。玉枢丹用于痰气交阻证泛吐痰涎甚多者（D错）。